与“社会病”相关的两个社会学术语包括
A. 心里病态和反社会人格障碍
B. 社会问题和越轨行为
C. 心里病态和社会问题
D. 心里病态和越轨行为
E. 反社会人格障碍和越轨行为

正确答案：B。社会问题和越轨行为

解析：本题考查“社会病”的社会学术语分类。与“社会病”相关的社会学术语有两个，一个是“社会问题”，另一个是“越轨行为”（B对ACDE错）。